全口义齿修复中，对大气压力固位影响最大的是
A. 制取印模
B. 垂直距离确定
C. 正中关系确定
D. 排牙
E. 调（牙合）

正确答案：A。制取印模

解析：印模应该获得精确地义齿支持组织的解剖形态，以保证义齿基托与支持组织密合、边缘封闭良好，则大气压力的作用越强。所以对于全口义齿修复中大气压力的最大影响是印模的制取。掌握“全口义齿固位及稳定”知识点。